患牙龈炎的患者禁用
A. 氟化自来水
B. 含氟涂料
C. 局部涂氟
D. 含氟泡沫
E. 含氟牙线

正确答案：B。含氟涂料

解析：含氟涂料的缺点是涂布后可导致牙齿短暂时间内的变色，刷牙可使其恢复正常；少数患者可对其产生接触性过敏；牙龈出血者禁用。掌握“菌斑控制及提高宿主抵抗力”知识点。